抑制食物中非血红素铁吸收的物质是
A. 植酸
B. 肉类因子
C. 维生素C
D. 乳酸
E. 维生素B₂

正确答案：A。植酸